诊断小儿咳嗽变异性哮喘的基本条件不包括
A. 咳嗽持续 ＞4 周，常在运动、夜间和（或）凌晨发作或加重
B. 排除其他原因引起的慢性咳嗽
C. 临床无感染征象
D. 用支气管扩张剂可使咳嗽发作缓解
E. 有个人或家族过敏史

正确答案：E。有个人或家族过敏史

解析：咳嗽变异型哮喘诊断基本条件包括  1） 咳嗽持续 ＞4 周，常在运动、夜间和（或）凌晨发作或加重（A对），以干咳为主，不伴有喘息。2） 临床上无感染征象（C对），或经较长时间抗生素治疗无效 。3） 抗哮喘药物诊断性治疗有效（D对）。4） 排除其他原因引起的慢性咳嗽（B对） 。有个人或家族过敏史（E错，为本题正确答案）为哮喘发病机制之一。